嘌呤核苷酸的分解代谢终产物
A. 尿酸
B. 酮体
C. β-丙氨酸
D. β氨基异丁酸
E. 尿素

正确答案：A。尿酸

解析：嘌呤核苷酸的分解代谢终产物是尿酸（A对）。酮体（B错）是由脂肪酸在肝内β-氧化产生的大量乙酰CoA合成的。β-丙氨酸（C错）是胞嘧啶和尿嘧啶的分解代谢产物。β-氨基异丁酸（D错）是胸腺嘧啶的分解代谢产物。尿素（E错）是鸟苷酸循环的终产物。